化合物结构类型为异黄酮的是
A. 槲皮素
B. 黄芩素
C. 丹参素
D. 葛根素
E. 花青素

正确答案：D。葛根素

解析：本题考查的是黄酮类化合物的结构与分类。化合物结构类型为异黄酮的是葛根素（D对）。葛根素为葛根的主要化学成分。葛根含异黄酮类化合物，主要成分有大豆素、大豆苷、大豆素-7，4'-二葡萄糖苷及葛根素、葛根素-7-木糖苷。槲皮素（A错）为银杏叶的化学成分之一。银杏叶中的黄酮类化合物有黄酮、黄酮醇及其苷类、双黄酮和儿茶素类等。《中国药典》以总黄酮醇苷和萜类内酯为指标成分进行含量测定。要求总黄酮醇苷不少于0.4%，对照品采用槲皮素、山柰素和异鼠李素；要求萜类内酯不少于0.25%，对照品采用银杏内酯A、银杏内酯B、银杏内酯C和白果内酯。到目前为止，已从银杏叶中分离出20多个黄酮类化合物，其结构大体可分为山柰酚类、槲皮素类、木犀草素、二粒小麦黄酮、儿茶素类和双黄酮类。黄芩素（B错）为黄芩的主要化学成分。黄芩中主要成分及其化学结构：从黄芩中分离出来的黄酮类化合物有黄芩苷（含4.0%～5.2%）、黄芩素、汉黄芩苷、汉黄芩素等20种成分。丹参素（C错）为丹参的主要化学成分。丹参中的化学成分主要分为两类：脂溶性的二萜醌类化合物和水溶性的酚酸类成分。二萜醌类化合物大部分为丹参酮型的二萜醌类化合物，包括邻醌型的丹参酮类二萜和对醌型的罗列酮类二萜及其他类型。酚酸类成分主要是丹参素、丹酚酸A、丹酚酸B、丹酚酸C、迷迭香酸、原儿茶酸、紫草酸单甲酯，其中丹酚酸B是丹参中酚性酸的主要成分。